流行性乙型脑炎，病理变化为
A. 变质性炎
B. 化脓性炎
C. 增生性炎
D. 出血性炎
E. 假膜性炎

正确答案：A。变质性炎

解析：流行性乙型脑炎病变性质为变质性炎症（A对）。镜下所见：①神经细胞变性、坏死：轻者出现核偏位，尼氏小体消失，重者发生坏死。在变性、坏死的神经细胞周围，常有增生的少突胶质细胞围绕，称为神经细胞卫星现象；小胶质细胞及中性粒细胞侵入变性、坏死的神经细胞内，称为噬神经细胞现象。②软化灶形成：神经组织发生局灶性坏死液化，形成质地疏松、染色较浅的筛网状病灶，称为软化灶。③脑血管改变：脑实质血管充血，血管周围间隙增宽，以淋巴细胞为主的炎细胞常围绕血管呈袖套状浸润，称为淋巴细胞套。④胶质细胞增生：呈弥漫性或灶性分布，如增生的小胶质细胞聚积成群则形成小胶质细胞结节。肉眼观察，可见软脑膜及脑实质充血、水肿，严重者可有点状出血及粟粒大小、灰白色的软化灶。